关于牙周炎症的活动性破坏期的描述，哪一项不正确
A. 龈下非附着菌斑大量增加
B. 出现逆行性牙髓炎症状
C. 附着丧失
D. 牙槽骨吸收
E. 菌斑中厌氧菌和螺旋体比例上升

正确答案：B。出现逆行性牙髓炎症状

解析：本题考查牙周炎症的活动性破坏期。逆行性牙髓炎（B错，为本题的正确答案）是由于牙周袋内的细菌、毒素通过根尖孔或近根尖处的根管侧支进入牙髓，先引起近根尖处的牙髓充血和发炎，以后，局限的慢性牙髓炎可急性发作，是牙周-牙髓联合病变，不是牙周炎活动性破坏期的表现。牙周炎活动期时，龈下非附着菌斑大量增加（A对）。严重的炎症可导致牙龈结缔组织中的胶原纤维水解，结合上皮向根方增殖和牙槽骨吸收（D对），造成附着丧失（C对）。随着菌斑的成熟，细菌种类逐渐增多，菌斑大小和厚度随之增加，菌斑中厌氧菌和螺旋体比例上升（E对）。